与健康较为密切的人口结构是
A. 文化和婚姻
B. 年龄和性别
C. 性别和婚姻
D. 职业和文化
E. 年龄和职业

正确答案：B。年龄和性别